盐酸普鲁卡因的杂质是
A. 游离水杨酸
B. 对氨基苯甲酸
C. 酮体
D. 罂粟酸
E. 多环芳烃

正确答案：B。对氨基苯甲酸

解析：本题考查盐酸普卡因的特殊杂质。盐酸普鲁卡因为对氨基苯甲酸酯类局麻药，其结构中有酯键，可发生水解反应。特别是在注射液制备过程中受灭菌温度、时间、溶液pH、贮藏时间以及光线和金属离子等因素的影响，易发生水解反应生成对氨基苯甲酸类（B对）的杂质。